注射剂中添加亚硫酸钠的目的是
A. 减轻疼痛
B. 防止药物氧化
C. 调节pH值
D. 防止药物水解
E. 抑制微生物增殖

正确答案：B。防止药物氧化

解析：本题考查的是注射剂的附加剂。注射剂中添加亚硫酸钠的目的是防止药物氧化（B对）。配制注射制剂时，可根据需要加入适宜的附加剂，如渗透压调节剂、pH调节剂、增溶剂、助溶剂、抗氧剂、抑菌剂、乳化剂、助悬剂等。所用附加剂应不影响药物疗效，避免对检验产生干扰，使用浓度不得引起毒性或明显的刺激性。（1）增溶剂、乳化剂和助悬剂：为了提高注射液中药物的溶解度，或制备乳状液型、混悬液型注射液的需要，在保证安全有效的前提下，可考虑加入适量的增溶剂或乳化剂、助悬剂等。除另有规定外，供静脉用的注射液，慎用增溶剂；椎管内注射用的注射液，不得添加增溶剂。常用增溶剂有聚山梨酯80、蛋黄卵磷脂、大豆磷脂等；聚山梨酯80、大豆磷脂、蛋黄卵磷脂也可用作乳化剂；甘油可用作助悬剂。（2）防止药物氧化的附加剂：①抗氧剂：抗氧剂是一类易被氧化的还原剂。常用抗氧剂有亚硫酸钠、亚硫酸氢钠和焦亚硫酸钠等，一般浓度为0.1%～0.2%。其中亚硫酸钠常用于偏碱性药液，亚硫酸氢钠和焦亚硫酸钠常用于偏酸性药液。②惰性气体：在注射剂的配制、灌封等生产过程中，为防止主药氧化，应在药液或空安瓿空间通惰性气体。常用的惰性气体有二氧化碳和氮气。③金属离子络合剂：有些注射剂，常因药液中含有微量金属离子的存在，而加速主药的氧化、变质，可加入能与金属离子络合的络合物，使与金属离子生成稳定的水溶性络合物，阻止其促进氧化，使药液稳定。常用金属离子络合剂有乙二胺四乙酸、乙二胺四乙酸二钠等，常用量为0.03%～0.05%。（3）调节渗透压的附加剂：凡与人体血液、泪液渗透压相同的溶液称为等渗溶液。大量注入低渗溶液会导致溶血，因此大容量注射液应调节渗透压。常用的调节渗透压的附加剂有氯化钠、葡萄糖等。调节方法有冰点降低数据法和氯化钠等渗当量法。（4）调节pH（C错）的附加剂：注射液的pH一般应控制在4.0～9.0之间，大剂量输入的注射液pH应接近中性。常用的调节pH的附加剂有盐酸、枸橼酸、氢氧化钠、氢氧化钾、碳酸氢钠、缓冲剂磷酸氢二钠和磷酸二氢钠等。（5）抑制微生物增殖（E错）的附加剂：多剂量包装的注射液可加适宜的抑菌剂。抑菌剂的用量应能抑制注射液中微生物的生长，在制剂确定处方时，该处方的抑菌效力应符合《中国药典》抑菌效率检查法的规定。常用抑菌剂为0.5%苯酚、0.3%甲酚、0.5%三氯叔丁醇、0.01%硫柳汞等。（6）减轻疼痛（A错）的附加剂：为减轻注射时的疼痛而加入的附加剂称为止痛剂，一般用于肌内或皮下注射的注射剂。常用的止痛剂有三氯叔丁醇、盐酸普鲁卡因、盐酸利多卡因等。防止药物水解（D错）：对于易水解的药物，有时采用非水溶剂如甘油、乙醇或丙二醇等使其稳定，有时加入表面活性剂，利用所形成胶束的屏障作用而延缓水解。